升结肠癌的主要临床表现为
A. 黑便
B. 里急后重
C. 贫血
D. 便秘
E. 肠梗阻

正确答案：C。贫血

解析：升结肠癌（右半结肠）以腹痛、腹部肿块和全身症状（C对）为主。降结肠癌（左侧结肠）以梗阻症状、排便习惯与粪便性状改变等症状为主（ABDE错）。